性微寒的行气药是
A. 木香
B. 香附
C. 沉香
D. 薤白
E. 枳实

正确答案：E。枳实

解析：该题考查的是枳实的药性，属记忆内容。枳实，为行气药，药性苦、辛、酸、微寒（E对）。注：枳实在七版教材性温，但在五版和九版教材中均性微寒。